因为结构中含有环氧桥，易进入中枢神经的药物是
A. 硫酸阿托品
B. 氢溴酸东莨菪碱
C. 氢溴酸山莨菪碱
D. 氢溴酸加兰他敏
E. 溴丙胺太林

正确答案：B。氢溴酸东莨菪碱

解析：本题考查氢溴酸东莨菪碱。氢溴酸东莨菪碱（B对）在6，7位间有一个β-取向的氧桥基团，脂溶性增强，易进入中枢神经系统；阿托品（A错）主要用其硫酸盐解除痉挛，减少分泌，可通过血脑屏障，不含环氧桥；氢溴酸山莨菪碱（C错）在6位有一个β-取向的羟基，分子极性增强，难以透过血脑屏障；氢溴酸加兰他敏（D错）有较弱的抗胆碱酯酶作用，能透过血脑屏障，不含环氧桥；溴丙胺太林（E错）为季铵化合物，是合成的M胆碱受体拮抗剂，不易透过血脑屏障，不含环氧桥。